治疗风湿热痹，宜选用的药物是
A. 桑寄生
B. 独活
C. 羌活
D. 防己
E. 威灵仙

正确答案：D。防己

解析：防己辛能行散，苦寒降泄，既能祛风除湿止痛，又能清热。对风湿痹证湿热偏盛，肢体酸重，关节红肿疼痛，及湿热身痛者，尤为要药（D对）。桑寄生的功效为祛风湿，补肝肾，强筋骨，安胎元。治疗治疗风湿痹痛，腰膝酸软，筋骨无力（A错）。独活的功效为祛风除湿，通痹止痛，解表。治疗风寒湿痹，腰膝疼痛；风寒夹湿头痛；少阴伏风头痛（B错）。羌活的功效为解表散寒，祛风除湿，止痛。治疗风寒感冒，头痛项强；风寒湿痹，肩背酸痛（C错）。威灵仙的功效为祛风湿，通经络，止痛，消骨骾。治疗风湿痹痛；骨骾咽喉（E错）。